男，26岁。坐位乘车时急刹车，右膝前受冲击，出现右髋剧痛，髋关节运动障碍，处于屈曲、内收、内旋畸形状态。应选择哪种治疗方法
A. Hippocrates法
B. Kocher法
C. Allis法
D. 骨牵引
E. 皮牵引

正确答案：C。Allis法

解析：男，26岁。坐位乘车时急刹车，右膝前受冲击，出现右髋剧痛，髋关节运动障碍，处于屈曲、内收、内旋畸形状态，考虑诊断为髋关节后脱位。髋关节后脱位绝大多数用手法复位治疗，为保持肌肉松弛，复位常在全麻或椎管内麻醉下进行，常用Allis法。应尽早、尽可能在24h内进行。如超过48h复位将十分困难。复位后患肢固定于外展中立位3周。卧床4周后扶双拐下地，3个月后才能完全持重。以免股骨头缺血坏死。该患者下地负重过早（4周），有可能发生股骨头缺血性坏死（C对）。